《素问·至真要大论》所述“诸热瞀瘛”的“瘛”，是指一种怎样的病状
A. 狂言乱语
B. 寒战口噤
C. 神志昏迷
D. 视物不清
E. 手足抽搐

正确答案：E。手足抽搐

解析：“诸热瞀瘛，皆属于火”的意思是多种出现神识昏糊、四肢抽搐等的热类病证，其病机大多属于火。这是由于火为热之极，火盛则身热；心藏神，火热扰心，蒙蔽心窍，则神识昏糊；火灼阴血，筋脉失养，可见肢体抽搐（E对）。